反映肺泡通气量的最佳指标是
A. 肺活量
B. 肺潮气量
C. PACO₂
D. PaCO₂
E. PaO₂

正确答案：D。PaCO₂

解析：反映肺泡通气量的最佳指标是PaCO₂（D对）。